哮证发作期的主要病机是
A. 外邪侵袭，肺失宣降
B. 肺失宣肃，肺气上逆
C. 痰气搏结，气道被阻
D. 邪袭于肺，肺气不利
E. 肺脏虚弱，气失所主

正确答案：C。痰气搏结，气道被阻

解析：哮证每因外感、饮食、情志、劳倦等诱因引动而触发，致痰阻气道，肺气上逆，气道挛急所致（C对）。外邪侵袭，肺失宣降是感冒的病机（A错）。肺失宣肃，肺气上逆是咳嗽的病机（B错）。邪袭于肺，肺气不利是外感咳嗽的病因病机之一（D错）。劳欲久病，久咳伤肺，或病久肺虚，气失所主，气阴亏耗，因而短气，是喘证虚证的病因之一（E错）。